临床既用于深部真菌感染，又用于浅表真菌感染的药物是
A. 克霉唑
B. 伊曲康唑
C. 灰黄霉素
D. 咪康唑
E. 制霉菌素

正确答案：B。伊曲康唑

解析：本题考查伊曲康唑。临床既用于深部真菌感染，又用于浅表真菌感染的药物是伊曲康唑（B对）。咪唑类和三唑类抗真菌药均为广谱抗真菌药，可抑制真菌细胞中的麦角固醇合成，抑制真菌生长。常用的有酮康唑、伊曲康唑、氟康唑。用于对新型隐球菌、白念珠菌等深部真菌感染和浅部真菌感染（如甲癣）的治疗。克霉唑（A错）口服吸收差，不良反应多且严重，目前仅供局部应用。灰黄霉素（C错）为非多烯类抗真菌抗生素，可以有效的治疗浅部真菌病,对念珠菌属及深部真菌感染无效。咪康唑（D错）口服吸收差，静脉给药不良反应多，故主要作为外用抗真菌药治疗皮肤黏膜感染。制霉菌素（E错）的化学结构和抗菌作用机制与两性霉素B基本相同。但其毒性更大，仅供局部应用治疗皮肤、口腔、膀胱和阴道的假丝酵母感染。